属于影响健康教育效果评价的参与者熟练性因素的是
A. 测量工具
B. 测试者观察偏倚
C. 调查人员技术熟练
D. 因搬迁不能对居民进行随访
E. 项目地区发生自然灾害

正确答案：C。调查人员技术熟练